关于截根术的手术方法叙述不正确的是
A. 作外斜切口及垂直切口，常规翻瓣，充分暴露分叉区
B. 用灭菌的涡轮手机在分叉的水平截根
C. 断面根管口倒充填
D. 将根分叉深部及拔牙窝内的病变组织刮净，修整不规则的骨嵴外形
E. 清洗创面后，将龈瓣复位缝合，放置塞治剂

正确答案：A。作外斜切口及垂直切口，常规翻瓣，充分暴露分叉区

解析：截根术的手术方法：①作内斜切口及垂直切口，常规翻瓣，充分暴露分叉区，彻底清创、根面平整。②截根：用灭菌的涡轮手机，安装细裂钻（最好为金刚砂钻）。在分叉的水平将患根截断并取出，注意要将分叉处完全切去，切忌残存树桩状的根面倒凹；修整截根面的外形，使从分叉区到牙冠接触区处形成流线型斜面，类似固定桥桥体的外形，以利于日后保持口腔卫生。③断面根管口倒充填：在断面暴露的根管处备洞，用充填材料倒充填。④将根分叉深部及拔牙窝内的病变组织刮净，必要时修整不规则的骨嵴外形。⑤清洗创面后，将龈瓣复位缝合，尽量覆盖截根区的创面。放置塞治剂。掌握“根分叉病变”知识点。